华佗再造丸是治疗中风恢复期和后遗症的常用成药，用于半身不遂、拘挛麻木、口眼㖞斜、言语不清等症，其除能活血化瘀外，又能
A. 化痰通络，行气止痛
B. 化痰通络，息风镇惊
C. 舒筋通络，行气止痛
D. 息风镇惊，舒筋通络
E. 祛风化痰，开窍行气

正确答案：A。化痰通络，行气止痛

解析：本题考查的是华佗再造丸的功能。华佗再造丸是治疗中风恢复期和后遗症的常用成药，用于半身不遂、拘挛麻木、口眼㖞斜、言语不清等症，其除能活血化瘀外，又能化痰通络，行气止痛（A对）。华佗再造丸：【功能】活血化瘀，化痰通络，行气止痛。抗栓再造丸：【功能】活血化瘀，舒筋通络，息风镇痉（D错）。功能为化痰通络，息风镇惊（B错）、舒筋通络，行气止痛（C错）或祛风化痰，开窍行气（E错）的中成药，2002年考试指南未明确说明。